肾静脉回流到
A. 肝门静脉
B. 肠干
C. 肠系膜上动脉
D. 腹腔干
E. 下腔静脉

正确答案：E。下腔静脉

解析：下腔静脉（E对）为肾静脉等的回流部位。